化合物经皮肤吸收脂/水分配系数近于1，最易吸收，显示其毒性
A. 脂/水分配系数与毒效应
B. 电离度与毒效应
C. 挥发度和蒸气压与毒效应
D. 绝对毒性和相对毒性与毒效应
E. 分散度与毒效应

正确答案：A。脂/水分配系数与毒效应

解析：本题考查脂/水分配系数与毒效应。化合物经皮肤吸收脂/水分配系数近于1，最易吸收，显示其毒性，说明了脂/水分配系数与毒效应的关系（A对BCDE错）。